不是分枝杆菌特性的是
A. 生长慢并有分枝生长的趋势
B. 抗酸染色阳性
C. 专性厌氧
D. 营养要求高
E. 毒力和耐药性均可发生变异

正确答案：C。专性厌氧